呼吸困难，咳粉红色泡沫样痰，双肺满布干湿啰音，双下肢无水肿，诊断宜首先考虑
A. 全心衰竭
B. 急性左心衰竭
C. 慢性右心衰竭
D. 慢性左心衰竭
E. 急性右心衰竭

正确答案：B。急性左心衰竭

解析：患者呼吸困难，咳粉红色泡沫痰（急性左心衰竭的特征性表现），双肺满布干湿啰音，双下肢无水肿，诊断宜首先考虑急性左心衰竭（B对）。慢性右心衰竭（AC错）主要以体循环淤血为主要表现，多伴有双下肢水肿、颈静脉怒张、肝脏淤血等典型体征。慢性左心衰竭（D错）不会出现咳粉红色泡沫样痰。急性右心衰竭（P174）（E错）指右心室心肌收缩力急剧下降或右心室的前后负荷突然加重，引起右心排血量急剧降低的临床综合征，也多为体循环淤血表现。